男，29岁，烧伤3h，烧伤总面积80%，其中深Ⅱ度30%，Ⅲ度50%，伤后无尿，心率150次/分，呼吸35次/分，伤后头8h输液4500ml（其中胶体800ml）后仍无尿。针对无尿首先应
A. 加快补液速度
B. 用利尿剂
C. 查血电解质、尿素氮及肌酐
D. 进一步询问病史，了解伤前情况
E. 检查膀胱区及导尿管

正确答案：E。检查膀胱区及导尿管

解析：因为此大面积烧伤病人进过常规补液应该能够检测到尿量，如果膀胱有尿潴留或者导尿管位置放置有误也有可能导致无尿，所以应该检查导尿管及膀胱区。掌握“火器伤、热烧伤”知识点。